下列有关牙演化特点的描述中，正确的一项是
A. 牙形由单一同形牙向复杂异形牙演化
B. 牙数目由少变多
C. 由双牙列向多牙列演化
D. 牙的分布由集中至逐渐广泛
E. 牙根从有到无

正确答案：A。牙形由单一同形牙向复杂异形牙演化

解析：牙演化的特点：①牙形由单一同形牙向复杂异形牙演化；②牙数目由多变少；③牙的替换次数由多牙列向双牙列演化；④牙的分布由广泛至逐渐集中于上、下颌骨；⑤牙根从无到有，牙附着于颌骨的方式由端生牙至侧生牙，最后向槽生牙演化。掌握“牙的演化”知识点。